下列关于立克次体叙述不正确的是
A. 原核细胞型微生物
B. 有细胞壁
C. 含有DNA不含RNA
D. 以二分裂方式繁殖
E. 对四环素和氯霉素等抗生素敏感

正确答案：C。含有DNA不含RNA

解析：立克次体是一类严格细胞内寄生的原核细胞型微生物，其生物学性状与细菌类似，有细胞壁，但形态多样，以二分裂方式繁殖，含有DNA和RNA，有较复杂的酶系统，专性细胞内寄生，对四环素和氯霉素等抗生素敏感。掌握“立克次氏体”知识点。